女，32岁，恶心，头晕，呕吐，脑膜刺激征阳性，体温38.9℃，HIV抗体阳性，wbc15×10⁹/L。脑脊液：细胞数200～300×10⁶，墨汁染色（+）。患者的治疗应为
A. 伊曲康唑
B. 氟康唑
C. 伏立康唑
D. 卡泊芬净
E. 制曲霉素

正确答案：B。氟康唑

解析：患者女，32岁，恶心，头晕，呕吐，脑膜刺激征阳性，体温38.9℃，HIV抗体阳性，wbc15×10⁹/L。脑脊液：细胞数200～300×10⁶，墨汁染色（+）（新型隐球菌脑膜炎的脑脊液检查结果），结合患者的表现和辅助检查，提示为新型隐球菌脑膜炎，应给予氟康唑，其余选项不属于新型隐球菌脑膜炎的治疗药物（B对）。